肿瘤抑制基因存在于
A. 正常细胞
B. 癌变细胞
C. 坏死细胞
D. 癌基因中
E. 以上都对

正确答案：A。正常细胞

解析：在正常细胞中存在一类肿瘤抑制基因，当这种基因缺失或变异时，抑瘤功能丧失，导致肿瘤生成。而在两种不同肿瘤细胞杂交融合后，由于它们缺失的抑癌基因不同，在形成的杂交体中，各自缺失的抑癌基因发生交叉互补，所以也不会形成肿瘤。掌握“癌基因与抑癌基因以及生长因子”知识点。